流行病学基本原理包括
A. 病因论
B. 疾病分布论
C. 疾病的预防控制理论
D. 健康-疾病连续带理论
E. 以上说法均正确

正确答案：E。以上说法均正确

解析：流行病学基本原理：①疾病分布论；②病因论；③健康-疾病连续带理论；④疾病的预防控制理论；⑤疾病流行数理模型。掌握“流行病学概论”知识点。